下列药物中，可以增加缺血性脑卒中发作风险的药物是
A. 口服避孕药
B. 叶酸
C. 阿司匹林
D. 银杏叶片
E. 非洛地平

正确答案：A。口服避孕药

解析：本题考查可增加缺血性脑卒中发作风险的药物。口服避孕药（A对）可增加缺血性脑卒中发作风险。叶酸（B错）应用期间会引起血钾降低，出现神经紊乱，麻痹，失钾性肾病等。阿司匹林（C错）大剂量长期服用，可抑制凝血酶合成，增加出血倾向。银杏叶片（D错）不良反应很少。非洛地平（E错）在极少数病人中可能会引起显著的低血压伴心动过速，这在易感个体可能会引起心肌缺氧。